旨在矫正错位牙、调整不协调的牙弓与（牙合）关系、利于手术进行的属于
A. 术后正畸治疗
B. 追踪观察
C. 完成术前准备
D. 确认手术计划
E. 术前正畸治疗

正确答案：E。术前正畸治疗

解析：术前正畸治疗：旨在矫正错位牙，调整不协调的牙弓与（牙合）关系，排齐牙列，消除牙的代偿性倾斜。这是否获得功能与形态效果俱佳的一个十分重要的步骤。掌握“牙颌面畸形”知识点。